细菌荚膜的主要功能是
A. 传递遗传物质
B. 穿透作用
C. 抗热作用
D. 供给营养
E. 抗吞噬作用

正确答案：E。抗吞噬作用

解析：细菌荚膜是细菌的特殊结构。荚膜的功能有：抗吞噬作用（E对）、黏附作用、抗有害物质的损伤作用。